女，34岁，月经增多，脱发，实验室检查：dsDNA（+），ANCA（+），尿蛋白（+++），最可能的诊断是
A. 系统性红斑狼疮
B. 类风湿关节炎
C. 甲亢
D. 干燥综合征
E. 原发性血管炎

正确答案：A。系统性红斑狼疮

解析：患者女，34岁，月经增多，脱发（皮肤表现），实验室检查：dsDNA（+）（是诊断SLE的特异性抗体），ANCA（+），尿蛋白（+++）（提示系统性红斑狼疮为活动期），故根据患者的临床表现和实验室检查，诊断为系统性红斑狼疮疾病（A对）。